上述疾病中，脑脊液墨汁染色阳性的是
A. 结核性脑膜炎
B. 中毒性脑病
C. 病毒性脑病
D. 隐球菌性脑膜炎
E. 化脓性脑膜炎

正确答案：D。隐球菌性脑膜炎

解析：墨汁染色是诊断隐球菌感染首选的方法，也是鉴别隐球菌性脑膜炎与结核性脑膜炎的关键（D对A错）。